根据《中华人民共和国药品管理法》，关于医疗机构药剂管理的说法，错误的有
A. 医疗机构须配备依法经过资格认定的药学技术人员
B. 医疗机构配制的制剂须有能够保证制剂质量的管理制度
C. 医疗机构配制的制剂经批准方可在市场销售
D. 医疗机构配制的制剂须按规定进行质量检验
E. 医疗机构配制的制剂须送所在地政府药品检验机构检验合格后方可使用

正确答案：C、E。医疗机构配制的制剂经批准方可在市场销售；医疗机构配制的制剂须送所在地政府药品检验机构检验合格后方可使用

解析：本题考查的是医疗机构配制制剂的管理。根据《中华人民共和国药品管理法》，关于医疗机构药剂管理的说法，错误的有医疗机构配制的制剂经批准方可在市场销售（C错，为本题正确答案）、医疗机构配制的制剂须送所在地政府药品检验机构检验合格后方可使用（E错，为本题正确答案）。医疗机构配制的制剂不得在市场上销售，不得发布医疗机构制剂广告。质量检验一般由医疗机构的药检室负责，检验合格后，凭医师处方使用。